矽肺是由于长期吸入哪种粉尘所致
A. 石棉
B. 滑石
C. 石英
D. 煤尘

正确答案：C。石英

解析：本题考查矽肺的病因。矽肺是由于在生产过程中长期吸入游离二氧化硅粉尘而引起的以肺部弥漫性纤维化为主的全身性疾病。游离SiO₂粉尘，俗称为矽尘，石英中的游离二氧化硅达99%，故常以石英（C对ABD错）尘作为矽尘的代表。